在体内经代谢可转化为骨化三醇的药物是
A. 维生素D₃
B. 维生素C
C. 维生素E
D. 维生素A
E. 维生素K₁

正确答案：A。维生素D₃

解析：本题考查维生素D₃。维生素D₃（A对）为胆骨化醇，本身无活性，须在肝脏和肾脏两次羟基化，代谢为骨化三醇起作用。维生素C（B错）为水溶性维生素，含烯醇基，极易氧化。维生素E（C错）脂溶性维生素，其水解产物为生育酚。维生素A（D错）为脂溶性维生素，在小肠被乳化吸收。维生素K₁（E错）主要是可以促进凝血以及抗骨质疏松。